服用磺胺类药物加服NaHCO₃的目的是
A. 增强抗菌疗效
B. 加快药物吸收速度
C. 防止过敏反应
D. 防止药物排泄过快而影响疗效
E. 使尿偏碱性，增加药物的溶解度

正确答案：E。使尿偏碱性，增加药物的溶解度